感染根管内的最主要的细菌
A. 变形性链球菌
B. 兼性厌氧菌
C. 专性厌氧菌
D. 金黄色葡萄球菌
E. 白色念球菌

正确答案：C。专性厌氧菌

解析：本题考查牙髓根尖周病各感染部位中的主要细菌-感染根管。牙髓组织坏死或坏疽，根管严重感染，牙髓腔内除了含有坏死牙髓的残余，还有大量细菌及毒性产物，故称之为感染根管。感染根管中，生物膜中细菌约占膜体积的15%，其中有数量相当的格兰阳性菌和格兰阴性菌，主要为专性厌氧菌（C对），主要存在于未治疗的感染根管中。变形性链球菌（A错）是龋病中的最主要细菌。兼性厌氧菌（B错）是治疗失败根管中的主要细菌之一。金黄色葡萄球菌（D错）是化脓性感染病灶内的最主要的细菌。白色念球菌（E错）是假膜性念珠菌感染粘膜表面的最主要的细菌。